研究生，晚自习后，因失恋，同时课题研究受阻，精神崩溃，生活的困扰情绪低落，有自杀念头，告知了自己的好朋友，此时采取最快速最有效的措施是？
A. 电话心理咨询
B. 门诊心理咨询
C. 社会心理咨询
D. 团体咨询
E. 面对面心理咨询

正确答案：A。电话心理咨询

解析：同学有了自杀念头，需要尽快得到心理治疗，电话心理咨询最快（A对）。